男性18岁患者，左上臂近端疼痛肿胀1月。就诊时X线片显示：左肱骨上段膨胀性囊状透亮区，边界清，内有骨性间隔将囊腔分成蜂窝状。最可能的诊断是
A. 骨囊肿
B. 骨纤维异样增殖症
C. 动脉瘤样骨囊肿
D. 内生性软骨瘤
E. 骨肉瘤

正确答案：C。动脉瘤样骨囊肿

解析：患者为青少年男性，左上臂近端疼痛肿胀，X线片示：左肱骨上段膨胀性囊状透亮区，边界清，内有骨性间隔将囊腔分成蜂窝状（动脉瘤样骨囊肿典型影像学表现），结合患者临床表现及影像学检查，最可能的诊断是动脉瘤样骨囊肿（C对）。动脉瘤样骨囊肿好发于青少年长骨干骺端，主要表现为疼痛和肿胀，X线表现为病变部位膨胀性囊状溶骨性改变，边界清，有骨性间隔，将囊腔分隔成蜂窝状或泡沫状。骨囊肿（P779）（A错）多无明显症状，X线表现为干骺端圆形或椭圆形界限清楚的溶骨性病灶，呈单房或多房性。骨纤维异样增殖症（P780）（B错）又称骨纤维发育不良，常无自觉症状，X线表现为受累骨骼膨胀变粗，密质骨变薄，典型特征是呈磨砂玻璃样改变，界限清楚。内生性软骨瘤（P797）（D错）以无痛性肿胀和畸形为主，X线主要表现为髓腔内椭圆形透亮点，呈溶骨性改变，皮质变薄无膨胀，溶骨区内有间隔或斑点状钙化影。骨肉瘤（P776）（E错）X线表现为骨质破坏，骨膜反应明显，可见Codman三角或呈“日光射线”形态。